夜卧早凉，热退无汗，热自阴来着，治疗宜选
A. 小柴胡汤
B. 黄连阿胶汤
C. 龙胆泻肝丸
D. 黄芩汤加豆豉玄参方
E. 青蒿鳖甲汤

正确答案：E。青蒿鳖甲汤

解析：“夜卧早凉，热退无汗，热自阴来着”说明此时阴液已亏，余邪留伏阴分，往往病情迁延，久久不解，病虽不重，但余邪逐渐消耗阴血，而见形体消瘦，舌红苔少，脉沉细数等症。治疗宜滋阴透热。方用青蒿鳖甲汤（E对）。方中青蒿芳香透络，与鳖甲相伍可入阴搜邪；鳖甲滋阴，合青蒿可使阴分之邪易于外透而解。再合以生地黄、丹皮、知母等，以助养阴清热之效。